栝蒌薤白白酒汤证的典型脉象是
A. 脉沉细
B. 寸口脉沉而迟，关上小紧数
C. 寸口关上微，尺中小紧
D. 寸口脉浮而缓，跌阳脉紧而数
E. 寸口脉浮而紧

正确答案：B。寸口脉沉而迟，关上小紧数

解析：原文“胸痹之病，喘息咳唾，胸背痛，短气，寸口脉沉而迟，关上小紧数，栝楼薤白白酒汤主之。”冠以“胸痹之病”，可知条文所述即胸痹病的主要脉症。寸候上焦，寸口脉沉而迟为胸阳不振；关候中焦，关上小紧数，为寒饮内停、正邪交争之脉象（B对）。